小青龙汤的功用是
A. 温肺化痰，止咳平喘
B. 解表散寒，温肺化饮
C. 温肺降气，祛痰平喘
D. 解表化饮，降气平喘
E. 温肺化痰，降气定喘

正确答案：B。解表散寒，温肺化饮

解析：本题考查方剂的功用。小青龙汤的功用是解表散寒，温肺化饮，主治外寒里饮证，为治疗外感风寒，寒饮内停喘咳的常用方（B对）。